消化性溃疡的主要症状是
A. 厌食、消瘦
B. 恶心、呕吐
C. 嗳气、反酸
D. 上腹疼痛
E. 呕血、黑便

正确答案：D。上腹疼痛

解析：上腹痛是消化性溃疡的主要症状，但部分患者可症状轻或无症状，而以出血、穿孔等并发症为首发症状。掌握“消化性溃疡”知识点。